可用于口腔疾病预防措施和预防方法的研究，并对其效果进行评价的是以下哪项
A. 口腔预防医学
B. 口腔流行病学
C. 口腔解剖学
D. 口腔统计学
E. 口腔修复学

正确答案：B。口腔流行病学

解析：口腔流行病学也可用于口腔疾病预防措施和预防方法的研究，并对其效果进行评价。掌握“口腔流行病学概述及研究方法”知识点。